效率较高、适用于工业生产散剂的分剂量方法是
A. 目测法
B. 等量递增法
C. 重量法
D. 估分法
E. 容量法

正确答案：E。容量法

解析：本题考查的是散剂的分剂量方法。效率较高、适用于工业生产散剂的分剂量方法是容量法（E对）。容量法系指用容量代替重量，用容量药匙或分量器等进行分剂量。该法效率高，可机械化生产，适用于大多数散剂。等量递增法（B错）亦称“配研法”，遵循药物粉末等比、等量容易混合均匀的原则，将量小的组分与等量的其他组分混合，均匀后再加入与混合物等量的组分混合，如此倍量增加，始终保持等量，直至将其他组分完全混入为止。该法混合效果好，省时，适用于含毒性药物、贵重药、剂量小药物的散剂。重量法（C错）系指用戥秤或天平逐包称量。该法剂量准确，但操作麻烦，效率低，难以机械化。适用于含毒性药物、贵重细料药物的散剂。